根据《麻醉药品和精神药品管理条例》，药品经营企业对第二类精神药品专用账册的保存期限为
A. 3年
B. 1年
C. 不少于5年
D. 药品有效期期满之日起不少于5年

正确答案：D。药品有效期期满之日起不少于5年

解析：本题考查第二类精神药品的储存。根据《麻醉药品和精神药品管理条例》，药品经营企业对第二类精神药品专用账册的保存期限为药品有效期期满之日起不少于5年（D对）。第二类精神药品经营企业，应当在药品库房中设立独立的专库或者专柜储存第二类精神药品，并建立专用账册，实行专人管理。专用账册的保存期限应当自药品有效期期满之日起不少于5年。医疗机构应当对麻醉药品和精神药品处方进行专册登记，加强管理。麻醉药品处方至少保存3年（A错），精神药品处方至少保存2年。托运或自行运输麻醉药品和第一类精神药品的单位，应当向所在地设区的市级药品监督管理部门申请领取《麻醉药品、第一类精神药品运输证明》。运输第二类精神药品无需办理运输证明。运输证明有效期为1年（B错）（不跨年度）。运输证明应当由专人保管，不得涂改、转让、转借。药品零售企业销售处方药的要求：药品零售企业销售处方应当按照国家处方药与非处方药分类管理有关规定，凭处方销售处方药，处方保留不少于5年（C错）。